患者，男，25岁，有癫痫病史2年，一直服用丙戊酸钠和左乙拉西坦，癫痫控制良好。近期因社区获得性肺炎入院。下列药物中，最可能影响患者基础疾病控制的是
A. 阿奇霉素
B. 头孢曲松
C. 阿莫西林
D. 莫西沙星
E. 米诺环素

正确答案：D。莫西沙星

解析：本题考查莫西沙星。最可能影响患者基础疾病控制的是莫西沙星（D对）。莫西沙星的不良反应为可诱发癫痫、Q-T间期延长、胃肠道反应。该患者既往癫痫病史，服用莫西沙星会诱发癫痫发作。阿奇霉素（A错）不良反应为消化不良、胃肠胀气、黏膜炎、口腔念珠菌病、胃炎等。头孢曲松（B错）不良反应为呕吐、口炎、腹痛、结肠炎、黄疸、胀气、味觉障碍和消化不良等。阿莫西林（C错）不良反应为贫血、血小板减少、嗜酸性粒细胞增多等。米诺环素（E错）不良反应为全血细胞减少症、粒细胞缺乏症、粒细胞减少、白细胞减少症、血小板减少症及贫血等。